控制医疗费用不合理增长的重要环节及控制医疗费用的守门人分别是
A. 三级医院服务，临床医生
B. 二级医院服务，临床医生
C. 一级医院服务，预防医师
D. 预防服务，预防医师
E. 社区卫生服务，全科医生

正确答案：E。社区卫生服务，全科医生